下列关于第一类和第二类疫苗的叙述，正确的是
A. 第二类疫苗由政府免费提供
B. 第一类疫苗由公民自费
C. 两种疫苗在接种时间上有冲突的，优先接种第一类疫苗
D. 狂犬病疫苗属于第一类疫苗
E. 第二类疫苗由公民自费国家强制接种

正确答案：C。两种疫苗在接种时间上有冲突的，优先接种第一类疫苗

解析：本题考查疫苗管理的相关内容。一类疫苗和二类疫苗在接种时间上有冲突的，原则上应优先接种一类疫苗（C对）；但在特殊情况下，用于预防紧急性疾病风险的二类疫苗，如狂犬病疫苗等其他需应急接种的疫苗，可优先接种。二类疫苗是由公民自费并且自愿接种的其他疫苗（AE错）。一类疫苗是政府免费向公民提供（B错）。狂犬疫苗属于二类疫苗（D错）。